男，30岁，火焰烧伤面颈部及双手3h，面颈部为Ⅲ度烧伤，体温37℃，心率96次/分，呼吸36次/分，声嘶，咽部红肿。首选治疗方案是上述哪项
A. 气管切开
B. 气管插管
C. 鼻饲给氧
D. 静脉切开或静脉穿刺插管
E. 静脉穿刺

正确答案：A。气管切开

解析：此患者为呼吸道吸入性烧伤导致喉头水肿，故应该进行气管切开术。掌握“火器伤、热烧伤”知识点。